哌替啶具有以下哪种作用
A. 镇痛作用
B. 抗炎作用
C. 两者皆有
D. 两者皆无

正确答案：A。镇痛作用

解析：本题考查哌替啶。哌替啶为阿片受体激动剂，主要兴奋µ受体，具有强镇痛作用（A对）；无抗炎作用（BCD错）。